某女，50岁。因燥热蕴肺导致咳嗽日久不愈，痰黄而黏，不易咳出，胸闷气促，久咳不止，声哑喉痛。治当清肺润燥、化痰止咳，宜选用的成药是
A. 蛤蚧定喘丸
B. 通宣理肺丸
C. 二母宁嗽丸
D. 人参保肺丸
E. 礞石滚痰丸

正确答案：C。二母宁嗽丸

解析：本题考查的是二母宁嗽丸功能。因燥热蕴肺导致咳嗽日久不愈，痰黄而黏，不易咳出，胸闷气促，久咳不止，声哑喉痛。治当清肺润燥、化痰止咳，宜选用的成药是二母宁嗽丸（C对）。二母宁嗽丸：【功能】清肺润燥，化痰止咳。蛤蚧定喘丸（A错）：【功能】滋阴清肺，止咳平喘。通宣理肺丸（B错）：【功能】解表散寒，宣肺止咳。人参保肺丸（D错）：【功能】益气补肺，止嗽定喘。礞石滚痰丸（E错）：【功能】逐痰降火。